心理健康标准不包括
A. 人格健全
B. 思想内容健康
C. 情绪乐观稳定
D. 行为和生活方式健康
E. 智力正常

正确答案：B。思想内容健康